下列哪种电磁辐射对皮肤无明显改变
A. 微波
B. 紫外线
C. 红外线
D. 激光
E. X射线

正确答案：A。微波

解析：本题考查电磁辐射对皮肤的影响。紫外线（B对）、红外线（C对）、激光（D对）、X射线（E对）均可对皮肤产生较大影响。而微波（A错，为本题正确答案）对皮肤作用较小，微波对机体的作用多见于眼部，严重可导致白内障。